医生处方时会将几种疗效基础相似或协同作用饮片缩写再一起并开，炒四仙应付的饮片有
A. 炒山楂
B. 炒槟榔
C. 炒谷芽
D. 炒神曲
E. 炒麦芽

正确答案：A、B、D、E。炒山楂；炒槟榔；炒神曲；炒麦芽

解析：本题考查的是饮片的处方应付。医生处方时会将几种疗效基础相似或协同作用饮片缩写再一起并开，炒四仙应付的饮片有炒山楂（A对）、炒槟榔（B对）、炒神曲（D对）、炒麦芽（E对）。焦四仙为焦神曲、焦山楂、焦麦芽、焦槟榔，据此可判断炒四仙为炒神曲、炒山楂、炒麦芽、炒槟榔。